肺泡回缩力主要来自
A. 肺泡的弹性纤维
B. 肺泡膜的液体分子层表面张力
C. 胸内负压
D. 胸廓弹性回缩
E. 肺泡表面活性物质

正确答案：B。肺泡膜的液体分子层表面张力